形成血瘀的常见原因
A. 气滞
B. 气虚
C. 外伤
D. 寒邪
E. 热邪

正确答案：A、B、D、E。气滞；气虚；寒邪；热邪

解析：本题考查的是血瘀形成原因。形成血瘀的常见原因气滞（A对）、气虚（B对）、寒邪（D对）与热邪（E对）。血瘀，是指血液的循行迟缓和不流畅的病机变化。气滞血行受阻，或气虚血运迟缓，或痰浊阻于脉络，或寒邪入血，或邪热煎熬血液等，均可形成血瘀，甚则血液瘀结而成瘀血。因此常可兼夹寒、热、痰、气滞，而形成寒凝血瘀、瘀热互结、痰瘀交阻、气滞血瘀等病证。血瘀可出现于不同部位，各有其特征。外伤（C错）可导致瘀血。瘀血，是指体内局部血液的停滞，包括离经之血积存体内，或血运不畅，阻滞于经脉、脏腑及其他部位的血液，均称为瘀血。瘀血的形成，一是由于气虚、气滞、血寒、血热等原因，使血行不畅而瘀滞。二是由于内外伤，或气虚失摄，或血热妄行等原因，引起血离经脉，积存于体内而形成瘀血。